髁突明显移位，成角畸形大于45°角，首选合理的治疗方法是
A. 单颌固定+颅颌弹性绷带
B. 颌间固定+颅颌弹性绷带
C. 单纯颌间固定
D. 在双侧磨牙后区垫以2～3mm厚橡皮垫，再用颅颌弹性绷带进行牵引
E. 手术切开复位固定

正确答案：E。手术切开复位固定

解析：本题考查牙槽突骨折、颌骨骨折。对髁突明显向下移位，成角畸形大于45°角、下颌支高度明显变短5mm，闭合复位不能获得良好咬合关系、髁突骨折片向颅中窝移位、髁突向外移位并突破关节囊者应视为手术适应证，应手术切开复位固定（E对）。